心理测验工作应遵守的原则为
A. 真诚、中立、回避
B. 自强、自立、自省
C. 信度、效度、常模
D. 客观、保密、标准化
E. 自主、学习、实效

正确答案：D。客观、保密、标准化